骨折治疗原则中的首要步骤是
A. 功能锻炼
B. 内固定
C. 复位
D. 包扎
E. 外固定

正确答案：C。复位

解析：骨折治疗的三大原则是复位、固定（包括内固定和外固定）、康复治疗（功能锻炼）。骨折治疗原则中的首要步骤是复位（C对），早期正确的复位，是骨折愈合过程顺利进行的必要条件。只有达到功能复位后才能进行内（B错）、外固定（E错），后期再进行功能锻炼（A错）。包扎（D错）为骨折的现场急救措施之一，不是治疗原则。